主要根据解离程度不同进行物质分离的方法是
A. 聚酰胺色谱法
B. 凝胶过滤法
C. 离子交换法
D. 硅胶柱色谱法
E. 纸色谱法

正确答案：C。离子交换法

解析：本题考查的是中药化学成分分离的原理。主要根据解离程度不同进行物质分离的方法是离子交换法（C对）。离子交换法：即离子色谱法。离子色谱法是根据物质解离程度不同进行分离。聚酰胺色谱法（A错）：聚酰胺吸附属于氢键吸附，力量较弱，介于物理吸附与化学吸附之间，也称半化学吸附。聚酰胺对黄酮类、醌类等化合物之间的氢键吸附效果较好，特别适合分离酚类、醌类、黄酮类化合物。凝胶过滤法（B错）：凝胶色谱法也称凝胶过滤法、凝胶渗透色谱法、分子筛过滤或排阻色谱，是根据物质分子大小差别进行分离。硅胶柱色谱法（D错）：是根据物质的吸附性差别进行分离的方法。硅胶为分离载体，即吸附剂。纸色谱法（E错）：纸色谱法实质上也是液液萃取法的原理，只是两相中其中一相以固态为基质，与某种液相形成饱和状态，进而达到分离的目的。